以下关于合成甘油磷脂的过程错误的是
A. 甘油、脂肪酸主要由糖代谢转变而来
B. 所需的一部分必需脂肪酸须靠食物供给
C. 乙醇胺可由体内丝氨酸脱羧生成
D. 胆碱可从食物中摄取
E. 甲基化作用需维生素B6和叶酸参与

正确答案：E。甲基化作用需维生素B6和叶酸参与

解析：甘油、脂肪酸主要由糖代谢转变而来，但所需的一部分必需脂肪酸须靠食物供给。乙醇胺可由体内丝氨酸脱羧生成；胆碱除从食物中摄取外，体内亦可经乙醇胺在酶催化下由3分子S-腺苷甲硫氨酸提供甲基生成。此甲基化作用需维生素B12和叶酸参与。合成除需ATP外，还需CTP参加。掌握“甘油磷脂、胆固醇和血脂蛋白代谢”知识点。